倾斜基牙固定桥取得共同就位道的方法中错误的是
A. 正畸
B. 预备
C. 改变固位体设计
D. 拔除倾斜牙
E. 双套冠

正确答案：D。拔除倾斜牙

解析：倾斜牙可以通过正畸治疗使其恢复正常，从而获得共同就位道。掌握“固定桥的生理基础”知识点。